青春期无排卵性功能失调性子宫出血的体温特点是
A. 基础体温单相，无低温相
B. 基础体温双相，高温相下降缓慢
C. 基础体温双相，低温相短
D. 基础体温双相，高温相短
E. 基础体温单相，无高温相

正确答案：E。基础体温单相，无高温相

解析：青春期由于中枢调节月经周期的功能尚未健全，促卵泡生长激素的水平高于促黄体生长激素，导致孕激素缺乏，而且垂体对卵巢的反馈也不够敏感。由于只有雌激素作用，而缺乏孕激素刺激下丘脑体温调节中枢，使基础体温升高，并一直持续到下次月经来潮前才开始下降，使体温呈单相型，而无高温相（E对A错）。基础体温双相，高温相下降缓慢（P346）（B错）是子宫内膜不规则脱落的体温特点。基础体温双相，高温相短（P346）（D错）是黄体功能不足的体温特点。基础体温双相，低温相短（C错）说法错误。